男，30岁，厨师。因数次大便排出白色条片，伴躯干部数个皮下结节就诊，既往体健，否认手术、外伤史，不嗜烟酒。为明确诊断，首选的检查是
A. 粪隐血
B. 皮下结节活检
C. 血清抗体检查
D. 血常规
E. 粪常规

正确答案：B。皮下结节活检

解析：青年男性，厨师（猪囊尾蚴感染高危人群）。数次大便排出白色条片，伴躯干部数个皮下结节（猪绛虫病典型体征），综合患者的病史、临表、体征，考虑诊断为猪绛虫病，为明确诊断，首选的检查是皮下结节活检，找到猪囊尾蚴可直接确诊（B对）。其余选项（ACDE错）均不是明确诊断的首选检查。